细菌进入创口几小时内尚未大量繁殖而易于清除
A. 6～12小时内
B. 14小时内
C. 20小时内
D. 24小时内
E. 32小时内

正确答案：A。6～12小时内

解析：细菌在进入创口6～12小时内，多停留在损伤组织的表浅部位，尚未大量繁殖，容易清除。掌握“口腔颌面部软组织创伤”知识点。